易引起静脉栓塞的疾病是
A. 妊娠合并急性病毒性肝炎
B. 妊娠合并糖尿病
C. 尿路感染
D. 妊娠合并心脏病
E. 妊娠合并甲亢

正确答案：D。妊娠合并心脏病

解析：易引起静脉栓塞的疾病是妊娠合并心脏病，妊娠时血液呈高凝状态，若合并心脏病伴静脉压增高及静脉淤滞者，可发生深部静脉血栓（D对）。妊娠合并急性病毒性肝炎，对孕妇来说，妊娠早期患有病毒性肝炎，可能使早孕反应加重。妊娠晚期时，妊娠高血压疾病发生率明显增加，分娩时易发生产后出血（A错）。易引起巨大儿的疾病是妊娠合并糖尿病（B错）。妊娠期尿路感染容易导致流产（C错）。妊娠合并甲亢易导致流产、早产、低体重或畸形（E错）。